小叶性肺炎的常见并发症不包括
A. 脓胸
B. 肺脓肿
C. 心力衰竭
D. 肺大疱
E. 呼吸功能衰竭

正确答案：D。肺大疱

解析：小叶性肺炎的常见并发症有呼吸功能衰竭（E对）、心力衰竭（C对）、肺脓肿（B对）和脓胸（A对）、脓毒血症等。肺大疱（D错，为本题正确答案）常并发于肺气肿、慢性阻塞性肺疾病（COPD）等。